慢性心房纤颤是指心房纤颤病史
A. 大于24小时
B. 大于48小时
C. 大于3天
D. 大于1个月
E. 大于3个月

正确答案：B。大于48小时

解析：本题为老题，九版内科学不再使用慢性心房纤颤这一分类方法。七版内科学教材P151提到初次发作的房颤且在24～48小时内，称为急性房颤。根据慢性房颤发生的持续情况，可分为阵发性、持续性、永久性。故推断慢性心房纤颤是指心房纤颤病史大于48小时（B对）。